糖尿病病人饮食为
A. 高热量 高蛋白 高维生素 低纤维素饮食
B. 控制总热量 低糖低脂 高纤维饮食
C. 低质低热量 少盐 粗纤维饮食
D. 高蛋白 高纤维素 高铁制品饮食
E. 低热量 低盐 高纤维 易消化

正确答案：B。控制总热量 低糖低脂 高纤维饮食

解析：糖尿糖尿病病人饮食治疗是糖尿病基础管理措施，其内容有：1.合理控制总热量；2.营养物质合理分配：糖尿病病人应选择低糖低脂食物，食用富含膳食纤维的食物（B对）；3.合理餐次分配；4.随访。高热量（A错）、低质低热量（CE错）、高蛋白（D错）均不属于糖尿病病人饮食治疗方法。